对于淋病引起的子宫颈炎治疗，错误的是
A. 常使用头孢菌素
B. 同时应用抗衣原体药物
C. 单次、大剂量治疗
D. 性伴侣同时治疗
E. 及时足量规范化

正确答案：C。单次、大剂量治疗

解析：淋病推荐联合使用头孢菌素（A对）和阿奇霉素（B对）。淋病要通过性接触传播，所以性伴侣同时治疗（D对）。足量用药为原则不是大剂量（C错，为本题正确答案）。